含有3，5-二羟基羧酸和嘧啶环骨架的HMG-CoA还原酶抑制剂的调血脂药物是
A. 瑞舒伐他汀钙
B. 洛伐他汀
C. 吉非罗齐
D. 非诺贝特
E. 氟伐他汀钠

正确答案：A。瑞舒伐他汀钙

解析：本题考查他汀类药物。瑞舒伐他汀钙（A对）是他汀类调血脂药，含有3，5二羟基羧酸，骨架为嘧啶环，能够抑制HMG-CoA还原酶。洛伐他汀（B错）含有羟基内酯，骨架是氢化萘环骨架。吉非罗齐（C错）、非诺贝特（D错）均是贝特类的降脂药物，前者为苯氧戊酸衍生物，后者为苯氧乙酸类。氟伐他汀钠（E错）不含嘧啶环，是将内酯环打开与钠离子反应成盐。